关于亚慢性毒性试验的目的，下列哪一项描述是错误的
A. 确定受试动物的最低致死剂量
B. 确定未观察到毒效应的剂量水平
C. 探讨亚慢性毒性的阈剂量
D. 为慢性毒性试验和致癌试验的剂量设计提供依据

正确答案：A。确定受试动物的最低致死剂量

解析：本题考查亚慢性毒性试验的目的。亚慢性毒性试验的目的是：探讨亚慢性毒性的阈剂量（C对）；确定长期接触受试物所致毒性作用的剂量-反应（效应）关系，确定其LOAEL和（或）NOAEL（B对）；为慢性毒性试验和致癌试验的剂量设计提供依据（D对）。确定受试动物的最低致死剂量（A错，为本题正确答案）不是亚慢性毒性试验的目的。